属于非政府机构的网站是
A. 中国药学会
B. 国家药品监督管理总局
C. 国家卫生和计划生育委员会
D. 美国FDA
E. 疾病预防和控制中心

正确答案：A。中国药学会

解析：本题考查互联网站。中国药学会（A错，为本题正确答案）是由全国药学科学技术工作者自愿组成依法登记成立的学术性、公益性、非盈利性的法人社会团体，属于非政府机构。国家药品监督管理总局（B对）、国家卫生和计划生育委员会（C对）、美国FDA（D对）、疾病预防控制中心（E对）均为政府机构。